目前在具有维生素E活性的物质的四种生育酚中，通常以何种作为维生素E的代表进行研究
A. α－生育酚
B. β－生育酚
C. γ－生育酚
D. δ－生育酚
E. 以上都不是

正确答案：A。α－生育酚